正常成人血清钠浓度为
A. 100~150mmol/L
B. 130~150mmol/L
C. 140~150mmol/L
D. 160~180mmol/L
E. 150~180mmol/L

正确答案：B。130~150mmol/L

解析：血清钠浓度的正常范围是135 -145mmol/L（B对），血清钠浓度低于135mmol/L称为低钠血症，血清钠浓度高于145mmol/L称为高钠血症。